妊娠合并心脏病阳虚水泛证的治疗方剂为
A. 养心汤
B. 归脾汤
C. 真武汤合五苓散
D. 补阳还五汤合瓜萎薤白半夏汤
E. 柏子仁丸

正确答案：C。真武汤合五苓散

解析：妊娠合并心脏病阳虚水泛证的病机是心肾阳虚，水湿内停，治宜温阳化气，行水安胎，方用温阳利水的真武汤合利水渗湿，温阳化气的五苓散。附子属于有毒之品，为妊娠禁忌药，应用时注意其炮制、用量、用法，并中病即止（C对）。养心汤（A错）主治妊娠合并心脏病之心气虚证；归脾汤（B错）主治妊娠合并心脏病之心血虚证；补阳还五汤合瓜萎薤白半夏汤（D错）主治妊娠合并心脏病之气虚血瘀证；柏子仁丸（E错）主治阴血亏虚，心肾失调。